过量服用可引起肝坏死的药物是
A. 布洛芬
B. 阿司匹林
C. 对乙酰氨基酚
D. 哌替啶
E. 吗啡

正确答案：C。对乙酰氨基酚